乌梅丸的药物组成不含
A. 附子、桂枝
B. 黄连、黄柏
C. 细辛、干姜
D. 当归、人参
E. 使君子、槟榔

正确答案：E。使君子、槟榔

解析：乌梅丸方含乌梅、细辛、干姜、黄连、当归、炮附子、蜀椒、桂枝、人参、黄柏（E错，为本题正确答案），以温脏安蛔，主治蛔厥证。乌梅丸方歌—乌梅丸用细辛桂，黄连黄柏及当归，人参附子椒姜继，温脏安蛔寒厥剂。